青少年龋患率高峰的年龄是
A. 2～5岁
B. 5～8岁
C. 6～12岁
D. 15～26岁
E. 以上均不对

正确答案：B。5～8岁

解析：本题考查青少年龋患率高峰的年龄。5～8岁（B对）的孩子乳牙开始脱落，恒牙逐渐萌出，尤其是新萌出的第一磨牙易被忽视，加上儿童口腔卫生不佳，易患龋，所以5～8岁是青少年龋患率高峰的年龄。2～5岁（A错）为乳牙列阶段，儿童的恒压尚未萌出，口腔较易清洁，患龋不如5到8岁高。6～12岁（C错）的青少年自我口腔保健意识加强，患龋机会减少。15～26岁（D错）的青少年恒牙已全部萌出，咬合稳定，自我菌斑控制意识强，龋病患病率低。